关于嵌体洞斜面的描述中错误的是
A. 增加密合度
B. 防止牙本质折断
C. 防止粘结剂被唾液溶解
D. 去除洞缘无基釉
E. 洞缘呈45°角

正确答案：B。防止牙本质折断

解析：洞缘有斜面：一般在洞缘牙釉质内预备出45°斜面，斜面宽度约0.5～1mm，并可根据（牙合）面情况对斜面深度和角度作适当调整。斜面预备的目的是：①去除洞缘无基釉，预防釉质折断。②增加嵌体的洞缘密合性与封闭作用，防止粘固剂被唾液溶解，减少微漏的发生。但洞缘斜面不能过大，否则会降低轴壁深度，影响固位力。斜面一般起于釉质层的1/2处。掌握“金属嵌体”知识点。